缺乳伴食少便溏者，应配合
A. 中脘、足三里
B. 太冲、三阴交
C. 中脘、天枢
D. 肝俞、膈俞
E. 期门、太冲

正确答案：C。中脘、天枢

解析：中脘为胃之募穴，腑之所会，可健运中州，调理气机；天枢为大肠募穴，理气止痛，活血散瘀，清利湿热；故缺乳伴食少便溏者宜选穴任脉的中脘、足阳明胃经的天枢（C对）。